临床上常用的升压药物是
A. 普萘洛尔
B. 去甲肾上腺素
C. 左旋多巴
D. 酚妥拉明
E. 肾上腺素

正确答案：B。去甲肾上腺素

解析：去甲肾上腺素（NE）主要与血管平滑肌α受体结合，也能与心肌β1受体结合，而与血管平滑肌β2受体结合的能力却较弱。静脉注射NE可使全身血管广泛收缩，外周阻力增加，动脉血压升高；而血压升高又使得压力感受性反射活动增强，由于压力感受性反射对心脏的效应超过NE，对心脏的直接效应，结果导致心率减慢。因此在临床上被用作升压药的是NE（B对）。普萘洛尔（A错）主要作用为降低心率。左旋多巴（C错）能明显改善帕金森病患者的症状。酚妥拉明（D错）能阻断α受体，降低血压。肾上腺素（E错）为强心药。